下列哪些抗肿瘤药物是烷化剂
A. 顺铂
B. 氟尿嘧啶
C. 环磷酰胺
D. 氮甲
E. 甲氨蝶呤

正确答案：C、D。环磷酰胺；氮甲

解析：本题考查烷化剂类抗肿瘤药。环磷酰胺（C对）、氮甲（D对）为烷化剂类抗肿瘤药。顺铂（A错）为金属配合物。氟尿嘧啶（B错）为干扰DNA合成的药物，甲氨蝶呤（E错）为叶酸拮抗剂。